治疗支气管哮喘缓解期脾虚证，应首选
A. 射干麻黄汤
B. 玉屏风散
C. 六君子汤
D. 定喘汤
E. 金匮肾气丸

正确答案：C。六君子汤

解析：六君子汤补气健脾，主治脾胃气虚证，为治疗支气管哮喘缓解期脾虚证的代表方（C对）。射干麻黄汤温肺化痰，化痰平喘，主治痰饮郁结，气逆喘咳证，为哮喘发作期寒哮的代表方（A错）。玉屏风散益气固表止汗，主治表虚自汗，亦治虚人腠理不固，易于感冒（B错）。定喘汤宣降肺气，清热化痰，主治痰热内蕴，风寒外束之哮喘（D错）。金匮肾气丸补肾助阳，化生肾气，主治肾阳不足证，为治疗支气管哮喘缓解期肾虚证的代表方（E错）。